静脉注射某药100mg，立即采集血样，测出血药浓度为5㎍/ml，其表观分布容积约为
A. 5L
B. 2L
C. 20L
D. 50L
E. 20ml

正确答案：C。20L

解析：本题考查表观分布容积的计算。由表观分布容积的计算公式：V=X/C，其中X为体内药物量，V是表观分布容积，C是血药浓度。由题意可知，X=100mg，C=5㎍/mL=5mg/L，故可求得V=X/C=100mg/5mg/L=20L（C对）。